肝功能不全的感染患者避免应用的抗菌药物是
A. 头孢他啶
B. 妥布霉素
C. 琥乙红霉素
D. 青霉素
E. 阿莫西林

正确答案：C。琥乙红霉素

解析：本题考查肝功能不全患者用药。肝功能不全的感染患者避免应用的抗菌药物是琥乙红霉素（C对）。琥乙红霉素为红霉素酯化物。肝功能减退时代谢减少而致毒性反应发生或具肝毒性，应避免使用的药物有：四环素、土霉素、氯霉素、红霉素酯化物、磺胺药、酮康唑、咪康唑、利福平、异烟肼。抗菌药主要由肾排泄，无明显肝毒性的抗菌药物有：青霉素（D错）、头孢唑林、头孢他啶（A错）、氨基糖苷类（庆大霉素、妥布霉素（B错）、阿米卡星等）、多黏菌素类、万古霉素、单环菌素类、碳青霉烯类。